大气中度污染，表明大气质量指数I₁是
A. ≤0.49
B. 0.50～0.99
C. 1.00～1.49
D. 1.50～1.99
E. ≥2.00

正确答案：D。1.50～1.99

解析：本题考查大气质量指数I₁。根据表12-2 按大气质量指数（I₁）划分的大气质量级别，大气中度污染，表明大气质量指数I₁是1.50～1.99（D对ABCE错）。